有关睫状体的描述，错误的是
A. 在巩膜与角膜移行部内面
B. 前份有睫状突
C. 睫状体内有睫状肌
D. 有产生房水的功能
E. 睫状肌收缩可导致晶状体凸度减小

正确答案：E。睫状肌收缩可导致晶状体凸度减小

解析：睫状体在巩膜与角膜移行部内面（A对），前份有向内突出呈放射状排列的皱襞，即睫状突（B对）。睫状体内有睫状肌（C对），有产生房水的功能（D对）。睫状肌呈环形分布，收缩时，与其相连的睫状小带松弛，晶状体恢复原来的凸度，即晶状体凸度变大，而非减小（E错，为本题正确答案）。